下列哪一项不属于我国血压水平分类法
A. 正常血压
B. 正常高值
C. 单纯舒张期高血压
D. 1级高血压
E. 2级高血压

正确答案：C。单纯舒张期高血压

解析：高血压水平的定义和分类。注：当收缩压和舒张压分属于不同级别时，以较高的分级作为标准；以上标准适用于男、女性任何年龄的成人。掌握“原发性高血压”知识点。